26岁初孕妇，现妊娠40周，近半月头痛、眼花，今晨出现剧烈头痛并呕吐2次来院就诊。测血压180/110mmHg。听胎心发现胎心176次/分，胎心监护出现频繁晚期减速，此时恰当的处置应是
A. 静脉快速滴注甘露醇
B. 左侧卧位并吸氧
C. 立即行催产素静脉滴注引产
D. 静脉滴注硫酸镁
E. 立即行剖宫产术

正确答案：E。立即行剖宫产术

解析：考虑妊高症，既往血压是具有参考价值的病史；尿酸值增高，慢性高血压患者血尿酸值升高不明显，因此可用本病与慢性高血压的鉴别诊断；胎心176次/分，出现频发晚期减速：已经宫内窘迫了，此时需要紧急剖宫产。掌握“娠期高血压疾病”知识点。